女，8个月。因发热2天，抽搐2次，伴呕吐，吃奶量减少，喜哭，易怒就诊。母乳喂养。查体：精神差，前囟饱满，心肺腹无异常发现，肌张力增高，脑脊液检查：外观混浊，白细胞1000×10⁶/L，中性粒细胞为主，糖1mmol/L，氯化物107mmol/L，蛋白质2.0g/L。针对病因，首选的治疗药物是
A. 阿昔洛韦
B. 异烟肼
C. 甘露醇
D. 头孢曲松
E. 氯康唑

正确答案：D。头孢曲松

解析：患儿，有发热、抽搐、呕吐、前囟饱满、肌张力增高的临床表现，并且脑脊液检查可见白细胞1000×10⁶/L（增高），中性粒细胞为主，糖1mmol/L（降低），氯化物107mmol/L（降低），蛋白质2.0g/L（明显增高），因此该患儿最可能诊断的是化脓性脑膜炎。对于化脓性脑膜炎应首选快速起效的头孢菌素，选项中只有头孢曲松属于头孢菌素（D对）。阿昔洛韦对病毒性脑膜炎有效（A错）。异烟肼对结核性脑膜炎有效（Ｂ错）。甘露醇对脑水肿有效，对脑膜炎没有根本的作用（Ｃ错）。氯康唑对化脓性脑膜炎的治疗不敏感（Ｅ错）。